夏季，3岁小儿突然高热体温40℃，惊厥1次。体检：神清，面色红。咽红，心、肺、腹（-），神经系统未见异常。首先应采取的治疗
A. 控制惊厥发作
B. 及早选用有效抗生素进行治疗
C. 保证足够的热量及液体
D. 急性期可应用激素
E. 必要时抽放脑脊液以降压

正确答案：A。控制惊厥发作

解析：学龄前儿童，夏季突发高热，体温40℃，惊厥1次，查体：神清，面色红，咽红，心、肺、腹（-），神经系统未见异常，根据患儿的临床症状及体征，考虑最可能的诊断为高热惊厥，首先应采取的治疗是控制惊厥发作（A对），该病是良性病程，目前最主要的是如何应对急性发作，对于单纯性热性惊厥患儿不推荐任何预防性治疗。